调节性T细胞（Treg）不表达
A. CD79a
B. CD3
C. CD25
D. TCR
E. Foxp3

正确答案：A。CD79a